近年来对治疗痢疾杆菌引起的疾病，首选抗菌药物是
A. 卡那霉素
B. 庆大霉素
C. 四环素
D. 喹诺酮类
E. 青霉素

正确答案：D。喹诺酮类

解析：喹诺酮类（D对）属于人工合成的抗菌药，目前亦有四代喹诺酮类抗菌药，均对革兰阴性菌具有强大的杀菌能力，痢疾杆菌属于革兰阴性菌，可首选喹诺酮类进行治疗。卡那霉素（A错）抗菌谱与链霉素相似，对结核杆菌作用稍强，不用于治疗痢疾。庆大霉素（B错）主要用于治疗各种格兰阴性杆菌感染如败血症、脑膜炎、骨髓炎、肺炎、泌尿道感染、胆道感染等。四环素（C错）对革兰阳性菌和革兰阴性菌均有抑制作用，对革兰阳性菌作用比阴性菌强，首选用于鼠疫、霍乱、布鲁菌病、幽门螺旋杆菌等。青霉素（E错）的抗菌作用较强。临床主要用于革兰阳性球菌感染如大叶性肺炎、支气管肺炎等；革兰阳性杆菌感染如白喉、气性坏疽、破伤风等，对革兰阴性菌，仅用于革兰阴性球菌感染如淋球菌感染、脑膜炎双球菌感染等。